易于为年幼儿童学习和掌握的刷牙方法是
A. BASS刷牙法
B. 水平颤动拂刷法
C. Fones刷牙法
D. Smith刷牙法
E. 改良Smith刷牙法

正确答案：C。Fones刷牙法

解析：本题考查刷牙方法。易于为年幼儿童学习和掌握的刷牙方法是Fones刷牙法（C对）。刷牙方法：1.圆弧刷牙法：又称Fones刷牙法，这种方法适用于儿童。2.水平颤动拂刷法（B错）（改良bass刷牙法）：是一种有效清除龈沟内和牙面菌斑的刷牙方法。水平颤动拂刷法适合于成年人使用，能够掌握此方法的青少年也可使用。水平颤动主要是去除牙颈部及龈沟内的菌斑，拂刷主要是清除唇（颊）舌（腭）面的菌斑。